腹部闭合性损伤合并出血性休克的处理原则是
A. 急诊剖腹探查
B. 输血并给止血药
C. 积极抗休克同时剖腹探查
D. 积极抗休克，休克纠正后手术探查
E. 输血并给抗生素

正确答案：C。积极抗休克同时剖腹探查

解析：腹部闭合性损伤并失血性休克提示腹腔内实质性脏器破裂出血或大血管损伤，由于出血量较大、病情进展较快，因此应积极抗休克的同时剖腹探查（C对D错），以彻底控制出血，纠正休克。如不经抗休克治疗，直接急诊剖腹探查会增加手术风险（A错）。输血可扩充血容量，缓解休克症状，但不能从根本上解决引起失血的原因；止血药物对脏器破裂出血和大血管损伤出血的止血效果有限（B错），可作为辅助治疗方法。抗生素可预防感染，为腹部损伤的一般治疗措施（E错）。